生态系统由四部分组成，即
A. 生产者，一级消费者，二级消费者，分解者
B. 生物群体、空气、土壤、水
C. 生产者、消费者、分解者、非生命物质
D. 生态平衡、物质循环、能量流动、信息传递
E. 水圈、气圈、岩石圈、生物圈

正确答案：C。生产者、消费者、分解者、非生命物质

解析：本题考查生态系统的组成。生态系统由四部分组成，即生产者、消费者、分解者、非生命物质（C对ABDE错）。